当一种药物与特异性受体结合后，阻止激动药与其结合，产生的相互作用属于
A. 增敏作用
B. 脱敏作用
C. 相加作用
D. 生理性拮抗
E. 药理性拮抗

正确答案：E。药理性拮抗

解析：本题考查药物的相互作用。药理性拮抗（E对）是指当一种药物与特异性受体结合后，阻止激动剂与其结合。如H₁组胺受体拮抗药苯海拉明可拮抗H₁组胺受体激动药的作用；增敏作用（A错）指某药可使组织或受体对另一药的敏感性增强；脱敏作用（B错）指某药可使组织或受体对另一药物的敏感性减弱；相加作用（C错）是两药的合用效应是两药分别作用的代数和；生理性拮抗（D错）是指合用的两种药物作用的受体生理效应相反。